3岁儿童的正常体重大约为
A. 10kg
B. 16kg
C. 12kg
D. 14kg
E. 20kg

正确答案：D。14kg

解析：小儿出生时体重平均3kg，1岁时约为出生时的3倍，2岁时约为出生时的4倍，本病例儿童年龄3岁，故可运用上述公式，体重（kg）=8+2×3=14kg（D对）。